促胰岛素分泌的的药物是
A. 罗格列酮
B. 吡格列酮
C. 二甲双胍
D. 格列齐特
E. 阿波卡糖

正确答案：D。格列齐特

解析：本题考查降糖药。促胰岛素分泌的的药物是格列齐特（D对）。格列齐特为磺酰脲类，可剌激胰岛β细胞释放胰岛素，促胰岛素分泌。罗格列酮（A错）、吡格列酮（B错）属噻唑烷二酮类胰岛素增敏剂，其作用机制与特异性过氧化物酶体增殖因子激活剂的γ型受体（PPARγ）有关。通过增加骨骼肌、肝脏、脂肪组织对胰岛素的敏感性，提高细胞对葡萄糖的利用而发挥降低血糖的疗效，可明显降低空腹血糖及胰岛素和C肽水平，对餐后血糖和胰岛素亦有降低作用。二甲双胍（C错）主要药理作用是减少肝葡萄糖的输出和改善外周胰岛素抵抗。阿波卡糖（E错）是α-葡萄糖苷酶抑制剂。此类药物在小肠上皮刷状缘与碳水化合物竞争水解碳水化合物的糖苷水解酶，从而减慢碳水化合物水解及产生葡萄糖的速度并延缓葡萄糖的吸收。